接受多西他赛治疗的患者，为减少多西他赛导致的水钠潴留和超敏反应，所采取的下列预处理方案中正确的是
A. 使用多西他赛前，先口服叶酸片，5mg，bid，持续3天
B. 在使用多西他赛前，先口服地塞米松，8mg，bid，持续3天
C. 输注多西他赛前30分钟，肌注维生素B₁₂，0.1mg
D. 输注多西他赛前，先肌注苯海拉明，25mg，q8h，持续3天
E. 在使用多西他赛前30分钟，口服奥美拉唑肠溶片20mg

正确答案：B。在使用多西他赛前，先口服地塞米松，8mg，bid，持续3天

解析：本题考查多西他赛。接受多西他赛治疗的患者，为减少多西他赛导致的水钠潴留和超敏反应，在使用多西他赛前，应先口服地塞米松，8mg，bid，持续3天（B对）。地塞米松在多西他赛滴注一天前服用，每天16mg，持续至少3天，以预防过敏反应和体液潴留。